常通过食物链的方式进入人体的污染物是
A. 二氧化硫
B. 一氧化碳
C. 有机氟
D. 有机氯
E. 有机磷

正确答案：D。有机氯

解析：本题考查常通过食物链的方式进入人体的污染物。有机氯（D对ABCE错）是指一类有机物，它们的分子中含有氯原子，其主要的来源是污染物，如农药、消毒剂、染料、塑料等化学制品，主要通过食物链进入人体。